通风不良的阴沟中，主要有害气体是
A. 氯化氢
B. 氰化氢
C. 硫化氢
D. 氟化氢
E. 光气

正确答案：C。硫化氢